在脱矿层表面细菌侵入小管繁殖，小管扩张呈串珠状的是
A. 透明层
B. 脱矿层
C. 细菌侵入层
D. 坏死崩解层
E. 暗层

正确答案：C。细菌侵入层

解析：细菌侵入层位于脱矿层表面，细菌侵入小管并繁殖，有的小管被细菌所充满，小管扩张呈串珠状。掌握“牙本质，牙骨质龋”知识点。